早期浸润邻近的神经和血管的肿瘤是
A. 多形性腺瘤
B. 黏液表皮样癌
C. 恶性混合瘤
D. 腺样囊性癌
E. 基底细胞腺瘤

正确答案：D。腺样囊性癌

解析：本题考查腺样囊性癌。早期浸润邻近的神经和血管的肿瘤是腺样囊性癌（D对），常引起神经症状，如面瘫、疼痛、舌麻木或舌下神经麻痹，造成血行性转移。多形性腺瘤（A错）和基底细胞腺瘤（E错）为良性肿瘤，早期不呈浸润生长。黏液表皮样癌（B错）和恶性混合瘤（C错）为恶性肿瘤，可呈浸润生长，但早期不浸润邻近的神经和血管。